与受体具有很高亲和力和内在活性（α=1）的药物是
A. 完全激动药
B. 竞争性拮抗药
C. 部分激动药
D. 非竞争性拮抗剂
E. 负性激动药

正确答案：A。完全激动药

解析：本题考查作用于受体药物的分类。与受体具有很高亲和力和内在活性（α=1）的药物是完全激动药（A对）。完全激动药也称激动剂，有很大的亲和力和内在活性（α=1），能与受体结合并产生最大效应。竞争性拮抗药（B错）和非竞争性拮抗剂（D错）均为拮抗药，与受体结合具有较强的亲和力，但缺乏内在活性（α=0）。部分激动药（C错）具有较强亲和力，但内在活性低（α＜1）。负性激动药（E错）是指引起与原来的激动药相反的生理效应。